丁卡因的化学名称是
A. 4-（丁氨基）苯甲酸-2-（二乙氨基）乙酯
B. 4-（丁氨基）苯甲酸-2-（二甲氨基）乙酯
C. 3-（丁氨基）苯甲酸-2-（二乙氨基）乙酯
D. 3-（丁氨基）苯乙酸-2-（二乙氨基）乙酯
E. 4-（丁酰氨基）苯甲酸-2-（二甲氨基）乙酯

正确答案：B。4-（丁氨基）苯甲酸-2-（二甲氨基）乙酯